下列化合物中，具有发泡性质的有
A. 柴胡皂苷
B. 芦丁
C. 人参总皂苷
D. 绿原酸
E. 咖啡酸

正确答案：A、C。柴胡皂苷；人参总皂苷

解析：本题考查三萜皂苷与甾体皂苷的理化性质。具有发泡性质的有柴胡皂苷（Ａ对）、人参总皂苷（Ｃ对）。三萜皂苷与甾体皂苷具有发泡性，皂苷水溶液经强烈振荡能产生持久性的泡沫，且不因加热而消失，这是由于皂苷具有降低水溶液表面张力的缘故。柴胡皂苷、人参总皂苷为三萜皂苷。槐米含有芦丁（Ｂ错）、槲皮素、皂苷、白桦脂醇、槐二醇、槐米甲素、槐米乙素、槐米丙素和黏液质等。芦丁为黄酮类化合物。绿原酸（Ｄ错）为有机酸。芳香族有机酸：芳香酸在植物界中分布十分广泛，如羟基桂皮酸的衍生物普遍存在于中药中，尤以对羟基桂皮酸、咖啡酸（Ｅ错）、阿魏酸和芥子酸较为多见。